女性，20岁。颌面部跌伤4小时。无昏迷史，脉搏、血压、呼吸均正常。口腔检查：上唇有一个2cm长的穿通伤口，上2-2牙龈撕裂，轻摇之有骨块异常活动。下颌检查未见异常。后牙咬合关系正常，张口未受限。若上颌咬合片示：上2-2牙槽骨骨折。常用的固定方法是
A. 单颌牙弓夹板固定
B. 骨钉加自凝塑料外固定
C. 克氏针内固定
D. 皮质骨螺钉固定
E. 切开复位，骨间固定

正确答案：A。单颌牙弓夹板固定

解析：本题考查颌骨骨折的固定方法。若上颌咬合片示：上2-2牙槽骨骨折。常用的固定方法是单颌牙弓夹板固定（A对）。骨折块异常动度，牙龈撕裂，咬合正常，无张口受限，新鲜骨折并且移位不大的线形骨折宜使用手法复位，如牙槽突骨折、颏部线形骨折的复位。复位后应辅助颌间固定，如单颌牙弓夹板固定。这是临床最常用的方法。骨钉加金属支架或自凝塑胶外固定法（B错）：在骨折线的两侧经皮钻入骨钉，然后用金属杆和螺帽连接固定或用自凝塑胶连接骨钉以固定骨折块，口腔颌面外科中多用于颧骨骨折固定；克氏针内固定（C错）多用于固定短小骨折或撕脱骨折等应力不大的骨折固定，及骨科手术中临时骨折块的固定，配合外固定锁钉固定骨盆骨折、跟骨骨折、锁骨骨折等，口腔颌面外科中多用于下颌骨髁状突颈部骨折及颏部骨折。皮质螺纹钉（D错）常用于下颌骨的斜劈形骨折。手术切开复位（E错）主要用于有开放性创口的骨折、闭合性颌骨复杂骨折或已有错位愈合的陈旧性骨折。